关于纯水、注射用水和灭菌注射用水的错误表述是
A. 纯化水是原水经蒸馏等方法制得的供药用的水
B. 注射用水是纯化水经蒸馏所得的水
C. 灭菌注射用水是注射用水经灭菌所得的水
D. 纯化水可作配制普通药物制剂的溶剂
E. 注射用水是用于注射用灭菌粉末的溶剂

正确答案：E。注射用水是用于注射用灭菌粉末的溶剂

解析：本题考查注射用溶剂。灭菌注射用水主要用于注射用灭菌粉末的溶剂（E错，为本题正确答案）或注射剂的稀释剂。纯化水为饮用水经蒸熘法、离子交换法、反渗透法或其他适宜方法制得的制药用水（A对），不含任何附加剂。可作为配制普通药物制剂的溶剂（D对）或试验用水，口服、外用制剂配制用溶剂或稀释剂。注射用水为纯化水经蒸熘所得的水（B对）。灭菌注射用水为注射用水按照注射剂生产工艺制备所得（C对），不含任何添加剂。